苯胺中毒应选择下列哪种解毒剂
A. 小剂量美蓝
B. 硫代硫酸钠
C. 大剂量美蓝
D. 亚硝酸钠
E. 亚硝酸异戊酯

正确答案：A。小剂量美蓝

解析：本题考查苯胺中毒的治疗。短时间内吸收大量苯胺，可引起急性中毒，主要引起高铁血红蛋白血症，针对高铁血红蛋白血症的处理，常用小剂量亚甲蓝（美蓝（A对BCDE错））进行治疗。对于苯的氨基或硝基化合物中毒，应用小剂量亚甲蓝还原目前仍为最佳解毒治疗。